凡是水溶性的化合物，分子量大的利用载体，由高浓度向低浓度移动的通过生物膜方式
A. 简单扩散
B. 滤过
C. 主动转运
D. 载体扩散
E. 胞饮和吞噬

正确答案：D。载体扩散

解析：本题考查化学毒物通过生物膜的方式。凡是水溶性的化合物，分子量大的利用载体，由高浓度向低浓度移动的通过生物膜方式为载体扩散（D对ABCE错）。